眶下间隙向后可通向哪个间隙，面静脉连于内眦静脉经眼静脉与海绵窦相通，炎症可蔓延
A. 颞间隙
B. 翼颌间隙
C. 颞下间隙
D. 咬肌间隙
E. 颊间隙

正确答案：E。颊间隙

解析：眶下间隙邻近上颌前牙及前磨牙、鼻侧部及上唇，上述部位的化脓性炎症，可侵及眶下间隙。该间隙向后通颊间隙，并有面静脉及面动脉经过，面静脉连于内眦静脉经眼静脉与海绵窦相通，炎症可循此蔓延。掌握“面侧深区及颌面部各间隙的境界”知识点。